与胺碘酮延长心室肌APD作用机制有关的主要离子通道是
A. Na⁺通道
B. Ca²⁺通道
C. Mg²⁺通道
D. Cl⁻通道
E. K⁺通道

正确答案：E。K⁺通道

解析：心肌细胞复极过程2期即平台期是动作电位时程长短的主要原因，其形成机制是钙内流钾外流的结果，阻滞钾通道，钾外流减慢，故动作电位时程延长。胺碘酮是广谱抗心律失常药，可阻滞钾心室肌细胞动作电位的平台期中的K⁺通道（E对），延长动作电位时程。